肝络失养证胁痛的代表方是
A. 六味地黄丸
B. 一贯煎
C. 柴胡疏肝散
D. 龙胆泻肝汤
E. 血府逐瘀汤

正确答案：B。一贯煎

解析：胁痛肝络失养证的病机为肝肾阴亏，精血耗伤，肝络失养，治宜养阴柔肝，理气止痛，代表方为一贯煎（B对）。六味地黄丸功能滋阴补肾，为治疗癃闭之肾阴亏耗证的选方（A错）。柴胡疏肝散为肝气郁滞证之胁痛的代表方（C错）。龙胆泻肝汤为肝胆湿热证之胁痛的代表方（D错）。瘀血阻络证之胁痛的主方为血府逐瘀汤（E错）。